月经周期规则，末次月经2002年1月28日，预产期应是
A. 2002年11月1日
B. 2002年11月2日
C. 2002年11月3日
D. 2002年11月4日
E. 2002年11月5日

正确答案：D。2002年11月4日

解析：末次月经第1日是2002年1月28日，按照推算预产期的方法：按末次月经第1日算起，月份减3或加9，日数加7，可推算出预产期是2002年11月4日（D对）。